由甲戊二羟酸衍变而成的化合物类型是
A. 糖类
B. 有机酸类
C. 黄酮类
D. 木脂素类
E. 萜类

正确答案：E。萜类

解析：本题考查的是萜类的定义。由甲戊二羟酸衍变而成的化合物类型是萜类（E对）。萜类化合物是一类由甲戊二羟酸衍生而成，基本碳架多具有2个或2个以上异戊二烯单位（C5单位）结构特征的不同饱和程度的衍生物。糖类（A错）成分包括单糖、低聚糖（含2～10分子单糖）、多糖（含10个以上单糖），是植物体内含量最多的一类化学成分。有机酸类（B错）化合物是一类含羧基的化合物（不包括氨基酸），广泛分布在植物界中，存在于植物的花、叶、茎、果、根等部位，多数与钾、钠、钙等金属离子或生物碱结合成盐的形式存在，也有结合成酯存在的。黄酮类（C错）类化合物含有氧杂环，多存在于高等植物及羊齿类植物中。苔类中含有的黄酮类化合物为数不多，而藻类、霉菌、细菌中没有发现黄酮类化合物。黄酮类化合物的存在形式既有与糖结合成苷的，也有游离体。木脂素类（D错）是由C₆-C₃构成的一类天然产物。木脂素类多数是游离的，也有少量与糖结合成苷而存在，由于较广泛地存在于植物的木部和树脂中，或开始析出时呈树脂状，故称木脂素。